行业食品卫生标准是由
A. 国家标准化管理委员会审批发布
B. 国家卫生健康委员会审批发布
C. 地方人民政府制定和发布
D. 行业协会制定和发布
E. 企业自身审批发布

正确答案：B。国家卫生健康委员会审批发布